结核性腹膜炎的腹部外形常呈
A. 舟状腹
B. 板状腹
C. 气腹
D. 蛙腹或尖腹
E. 球状腹

正确答案：D。蛙腹或尖腹

解析：当腹腔内有大量液体聚集时称为腹水或腹腔积液。常见于肝硬化门静脉高压症，亦可见于心力衰竭、缩窄性心包炎、腹膜转移癌（肝癌、卵巢癌多见）、肾病综合征或结核性腹膜炎等。由于腹水重力的作用，平卧位时腹壁松弛，液体下沉于腹腔两侧，使腹部呈扁而宽状，称为蛙腹（D对）。舟状腹多见于显著消瘦、严重脱水及恶病质等，如慢性消耗性疾病晚期（结核病、败血症等）、恶性肿瘤、糖尿病、神经性厌食、垂体前叶功能减退及甲亢的晚期患者。严重者前腹壁极度凹陷，几乎贴近脊柱，常见到腹主动脉搏动，肋弓 、髂嵴和耻骨联合显露，使腹外形呈舟状，称舟状腹（A错）。全腹高度紧张见于急性胃肠穿孔或实质性脏器破裂所引起的急性弥漫性腹膜炎，此时腹壁明显紧张，甚至强直，硬如木板，称为板状腹（B错）。积气在腹膜腔内称为气腹，常见于胃肠穿孔或治疗性人工气腹，前者常伴有腹膜炎（C错）。腹内积气多在胃肠道内，称为胃肠胀气。胃肠大量积气可使全腹膨隆，腹部呈球形，两侧腹部膨出不明显，移动体位时腹部形状无明显改变。多见于各种原因引起的机械性肠梗阻或麻痹性肠梗阻（E错）。